鳖甲主治
A. 阴虚消渴
B. 肺虚久咳
C. 须发早白
D. 阴虚动风
E. 肺热咳嗽

正确答案：D。阴虚动风